腹股沟管的上壁是
A. 皮肤，皮下组织
B. 腹膜与腹横筋膜内侧的1/3尚有联合腱
C. 腹内斜肌和腹横肌下缘
D. 腹股沟韧带和腔隙韧带
E. 腹外斜肌腱膜

正确答案：C。腹内斜肌和腹横肌下缘

解析：腹股沟位于腹前壁的内下方，相当于腹内斜肌与腹横肌弓状下缘与腹股沟韧带之间的裂隙。前壁有皮肤、皮下组织和腹外斜肌腱膜，后壁是腹横筋膜和腹膜，上壁为腹内斜肌和腹横肌构成的弓状下缘（C对），下壁为腹股沟韧带和腔隙韧带。